按心力衰竭发展阶段分级，临床心力衰竭阶段至少相当于
A. NYHA分级Ⅱ级
B. NYHA分级Ⅳ级
C. NYHA分级Ⅰ级
D. NYHA分级Ⅲ级
E. Killip分级Ⅰ级

正确答案：A。NYHA分级Ⅱ级

解析：临床心力衰竭阶段指患者已有基础结构性心脏病，既往或目前有心衰的症状或体征。而在NYHA心功能分级方法中，达到NYHA分级Ⅱ级的患者体力活动轻度受限，一般活动下即可出现临床症状，说明NYHA分级Ⅱ级以上者都有心衰的临床症状和（或）体征，因此临床心力衰竭阶段至少相当于NYHA分级Ⅱ级（A对BCD错）。Killip分级（E错）是急性心肌梗死引起的心衰分级方法。